崩解剂加入方法对崩解速度、溶出速率的影响
A. 崩解速度:内加法>内外加法>外加法
B. 溶出速率:内加法>内外加法>外加法
C. 崩解速度:外加法>内外加法>内加法
D. 溶出速率:内加法>内外加法>外加法
E. 崩解速度:内外加法>内加法>外加法

正确答案：C。崩解速度:外加法>内外加法>内加法